细菌性痢疾多见
A. 菌血症
B. 败血症
C. 脓毒败血症
D. 病毒血症
E. 毒血症

正确答案：E。毒血症

解析：所有痢疾杆菌均可产生内毒素，细菌内毒素入血可致发热等全身中毒症状，严重者可引起急性微循环障碍，出现感染性休克、DIC或中毒性脑病等，临床表现为中毒性菌痢（休克型、脑型或混合型），即毒血症（E对ABCD错）。休克型主要临床表现为感染性休克，脑型主要临床表现为由脑水肿或脑疝引起的昏迷、抽搐及呼吸衰竭。